称为“生痰之源”的脏是
A. 肝
B. 脾
C. 肾
D. 肺
E. 心

正确答案：B。脾

解析：本题考查的是五脏的其他称谓。称为“生痰之源”的脏是脾（B对）。肝（A错）、肾（C错）、肺（D错）与心（E错），2022年考试指南未明确说明。肺为“贮痰之器”。